甾体母核A/B环为顺式的是
A. 胆酸
B. 别胆酸
C. 牛磺酸
D. 甘氨酸
E. 麝香酮

正确答案：A。胆酸

解析：本题考查的是胆汁酸类化学成分的结构特点。甾体母核A/B环为顺式的是胆酸（A对）。甾体母核A/B环为顺式稠合时称为正系，若为反式稠合则为别系，如胆酸为正系，别胆酸（B错）则为别系。天然胆汁酸是胆烷酸的衍生物，在动物的胆汁中通常与甘氨酸（D错）或牛磺酸（C错）的氨基以酰胺键结合成甘氨胆汁酸或牛磺胆汁酸，并以钠盐形式存在。麝香对中枢神经系统的作用也表现双向性，对处于抑制状态的中枢有明显的兴奋作用，对处于兴奋状态的中枢则起抑制作用，麝香酮（E错）是其活性成分。